女，55岁，健康查体发现右胸8cm×7cm占位，最可能诊断
A. 胸腺瘤
B. 心包囊肿
C. 神经源性肿瘤
D. 胸内甲状腺
E. 中心型肺癌

正确答案：C。神经源性肿瘤

解析：根据胸片（侧位）和CT所示可看出，该肿物位于后纵隔，而后纵隔最常见的肿瘤为神经源性肿瘤，故该患者最可能的诊断是神经源性肿瘤（C对）。胸腺瘤（A错）、胸内甲状腺（D错）多位于前上纵隔，心包囊肿（B错）多位于中纵隔。纵隔位于两侧胸膜腔之间，不包括肺，因此中心型肺癌（E错）不属于纵隔肿瘤。